与贫血无关的是
A. 叶酸
B. 维生素B₁
C. 维生素B₂
D. 维生素B₆
E. 维生素B₁₂

正确答案：B。维生素B₁